分泌组胺的细胞是
A. 肥大细胞
B. 主细胞
C. G细胞
D. 壁细胞
E. 黏液细胞

正确答案：A。肥大细胞

解析：组胺存在于肥大细胞（A对）内，亦存在肺、肝及胃的粘膜组织内，它主要介导过敏和炎症反应。主细胞主要分泌胃蛋白酶原（B错），G细胞主要分泌促胃液素（C错）和促肾上腺皮质激素样物质，壁细胞主要分泌胃酸和内因子（D错），黏液细胞主要分泌黏液（E错）。